男性，55岁，大量饮酒20余年，2天前停止饮酒，肢体粗大震颤，不认识家人，夜间吵闹，自称墙上有鬼，索要他姓名，有时大吼，并伴挥拳，最可能的诊断是
A. 酒精性痴呆
B. 酒精性幻觉症
C. 震颤谵妄
D. 柯萨可夫综合征
E. 酒精性妄想

正确答案：C。震颤谵妄

解析：肢体粗大震颤，不认识家人，夜间吵闹，自称墙上有鬼（符合戒断反应中的震颤谵妄），戒断反应分单纯性戒断反应、震颤谵妄、癫痫样发作（C对）。